关于细胞静息电位的论述，不正确的是
A. 细胞膜处于极化状态
B. 静息电位主要是由K⁺内流形成的
C. 静息状态下，细胞膜对K⁺通透性增高
D. 细胞在静息状态时处于外正内负的状态
E. 静息电位与膜两侧Na⁺-K⁺泵的活动有关

正确答案：B。静息电位主要是由K⁺内流形成的

解析：细胞的静息电位是细胞在静息状态时处于外正内负的状态（D对），这种安静时细胞膜两侧处于外正内负的状态称为极化（A对）。静息电位与膜两侧Na⁺-K⁺泵的活动有关（E对），Na⁺-K⁺泵通过主动转运维持细胞膜两侧Na⁺和K⁺的浓度差，为Na⁺和K⁺的跨膜扩散形成静息电位奠定基础。在静息状态下，细胞膜对K⁺的通透性增高（C对），K⁺向细胞外扩散而形成（B错，为本题正确答案）静息电位。